葛根芩连丸既能止泻止痢，又能
A. 疏风解表
B. 解表清热
C. 宣肺止咳
D. 益气解表
E. 解肌清热

正确答案：E。解肌清热

解析：本题考查的是葛根芩连丸的功能。葛根芩连丸既能止泻止痢，又能解肌清热（E对）。葛根芩连丸：【功能】解肌透表，清热解毒，利湿止泻。感冒清热颗粒：【功能】疏风散寒（A错），解表清热（B错）。桑菊感冒片：【功能】疏风清热，宣肺止咳（C错）。参苏丸：【功能】益气解表（D错），疏风散寒，祛痰止咳。